非甾体类抗炎药引起的典型药源性疾病是
A. 胃肠类疾病
B. 肌病
C. 神经系统疾病
D. 血液系统疾病
E. 心血管系统疾病

正确答案：A。胃肠类疾病

解析：本题考查药源性疾病。非甾体类抗炎药引起的典型药源性疾病是胃肠道不良反应（A对）。当非甾体抗炎药在抗炎镇痛所需剂量大于抑制COX-1时，出现严重胃肠道不良反应，造成胃肠道损伤、胃出血、胃溃疡、胃穿孔等。